确诊女性生殖道淋病奈瑟菌感染取分泌物部位是
A. 子宫腔
B. 宫颈管
C. 阴道口
D. 阴道壁
E. 肛周

正确答案：B。宫颈管

解析：确诊女性生殖道淋病奈瑟菌感染取分泌物部位是宫颈管（B对）。取宫颈管分泌物进行淋病奈瑟菌培养，是诊断淋病的金标准方法。其方法是：先拭去宫颈口分泌物，然后用棉拭子插入宫颈管1.5～2cm，转动并停留20～30秒，取出的宫颈管分泌物应注意保温、保湿，立即接种，培养阳性率为80%～90.5%。